乳岩的特点是
A. 乳块肿痛，皮色微红，按后痛甚
B. 乳块皮肉相连，溃破脓稀薄
C. 乳块呈卵圆形，表面光滑，推之活动
D. 乳块质地较软，月经后缩小
E. 肿块高低不平，质硬，推之不动

正确答案：E。肿块高低不平，质硬，推之不动

解析：乳岩的特点是乳房部出现质地坚硬的肿块，推之不移，表面不光滑，凹凸不平（E对）。乳块肿痛，皮色微红，按后痛甚可为乳痈的特点（A错）。乳块皮肉相连，溃破脓稀薄如痰为乳痨的特点（B错）。乳块呈卵圆形，表面光滑，推之活动为乳癖的特点（C错）。乳癖的肿块经前期增大变硬，经后稍见缩小变软，但总体质地中等或偏硬（D错）。